维系蛋白质分子中α螺旋的化学键是
A. 盐键
B. 疏水键
C. 氢键
D. 肽键
E. 二硫键

正确答案：C。氢键

解析：本题考查维系蛋白质分子中α螺旋的化学键。α螺旋属于蛋白质的二级结构，蛋白质的二级结构依靠氢键（C对ABDE错）维系。